心血管系统的组成，没有
A. 心
B. 动脉
C. 胸导管
D. 静脉
E. 毛细血管

正确答案：C。胸导管

解析：心（A对）、动脉（B对）、静脉（D对）、毛细血管（E对）均为心血管系统的组成，胸导管（C错，为本题正确答案）为淋巴导管，是淋巴系统的组成。